环甲膜切开术后插管时间最长不宜超过
A. 8小时
B. 10小时
C. 12小时
D. 24小时
E. 48小时

正确答案：E。48小时

解析：本题考查环甲膜切开术。环甲膜切开术后插管时间最长不宜超过48小时（E对），若套管留置过久，常导致环状软骨软化，继发喉狭窄，应在48小时内行常规气管切开术后，缝合环甲膜切开创口。